以下方法所鉴别的药物是，供试品经亚硝化反应后显橙黄色，随即转为橙红色
A. 布洛芬
B. 盐酸普鲁卡因
C. 苯巴比妥
D. 司可巴比妥钠
E. 硫喷妥钠

正确答案：C。苯巴比妥